在气雾剂中，氢氟烷烃可作为
A. 助悬剂
B. 絮凝剂
C. 潜溶剂
D. 润湿剂
E. 抛射剂

正确答案：E。抛射剂

解析：本题考查抛射剂。抛射剂（E对）一般可分为氯氟烷烃（俗称氟利昂，已不用）、氢氟烷烃、碳氢化合物及压缩气体四大类，丙烷属于其中的碳氢化合物。